下列哪—项可不必放置引流物
A. 创口渗液多
B. 无菌创口
C. 留有无效腔的创口
D. 术中止血不彻底的创口
E. 凝血功能低下的患者

正确答案：B。无菌创口

解析：本题考查外科引流的适应证。无菌创口（B错，为本题的正确答案）可不必放置引流物。无菌创口，特别是单纯整复手术，一般不放置引流。外科引流的适应证：1.感染或污染创口：感染创口如脓肿切开等必须放置引流物，以使腔内脓液得以不断排出；切口有严重感染或手术本身属于污染创口，为防止感染，也应考虑放置引流；清洁创口，特别是单纯整复手术，一般不放置引流。2.渗液多的创口（A对）：对范围广泛的大手术及部位深在的中等手术，考虑其术后仍有部分渗血、渗液，应放置引流。3.留有死腔的创口（C对）：凡术中因组织缺损较大、未能完全消灭死腔的口内、口外创口，必须放置引流。其引流物需放置于死腔底部，才能保证彻底引流。4.止血不全的创口：对术中止血不彻底（D对）和凝血功能低下的患者（E对），为防止血肿形成，也应放置引流。